修复体放到龈缘以下过多可能出现不良反应中，除外
A. 牙齿松动
B. 牙龈肿胀
C. 牙龈炎症
D. 牙龈退缩
E. 牙槽嵴顶吸收

正确答案：A。牙齿松动

解析：本题考查牙周健康与修复。牙槽骨吸收过多会造成牙体松动，而修复体放到龈下过多，并不是引起牙齿松动（A错，为本题正确答案）的原因。如果将修复体放到龈缘以下过多，可能出现两种不良反应：①组织为避让冠缘的激惹而发生牙槽嵴顶吸收（E对）和牙龈退缩（D对）；②牙龈发生炎症（C对）和肿胀（B对）。